关于病人的道德权利，下述提法中正确的是
A. 病人都享有稀有卫生资源分配的权利
B. 病人都有要求开假休息的权利
C. 医生在任何情况下都不能超越病人要求保密的权利
D. 病人被免除社会责任的权利是随意的
E. 知情同意是病人自主权的具体形式

正确答案：E。知情同意是病人自主权的具体形式

解析：知情同意是病人自主权的具体形式（E对）。在分配医疗卫生资源时，要坚持公平公正。病人平等医疗权的实现依赖于两个基本条件，即由国家所提供的可进行平等操作的“平台”，以及医务人员现代平等素质的打造（P67），稀有卫生资源并不是所有病人都可以享有的权利（A错）。不是所有病人都有要求开假休息的权利（B错），比如咽炎、骨质疏松、癔病等较轻的疾病是不能要求休假的。如果病人的“隐私”涉及了他人或社会的利益，对他人或社会具有一定的危害性，例如患有甲类传染病，则医务人员有疫情报告的义务，应当如实上报，但应对无关人员保密，而不是在任何情况下都为病人保密（C错）。病人被免除社会责任的权利不是随意的（D错），要以合法为前提。